可作为心血管不良事件一级和二级预防的药物是
A. 双氯芬酸
B. 对乙酰氨基酚
C. 塞来昔布
D. 阿司匹林
E. 尼美舒利

正确答案：D。阿司匹林

解析：本题考查药物的适应证。阿司匹林（D对）为环氧酶抑制剂，用于不稳定型心绞痛、急性心肌梗死等脑血管疾病。已经成为心血管事件一、二级预防的“基石”。双氯芬酸（A错）属于芳基乙酸类非甾体抗炎药，用于各种急慢性关节炎软组织风湿所致的头疼，以及创伤后、术后的疼痛等。对乙酰氨基酚（B错）属于乙酰苯胺类非甾体抗炎药，为缓解轻中度骨性关节炎疼痛的首选药。塞来昔布（C错）属于选择性COX-2抑制剂，用于缓解骨性关节炎、类风湿性关节炎、强制性脊柱炎的肿痛症状。尼美舒利（E错）是一种选择性COX-2抑制剂，用于慢性关节炎。